内消瘰疬丸是治皮下结构，不热不痛的常用成药，某外科医师经常使用。此因该成药除软坚，散结外，又能
A. 化痰
B. 燥湿
C. 拔毒
D. 化腐
E. 化瘀

正确答案：A。化痰

解析：本题考查的是内消瘰疬丸的功能。内消瘰疬丸除软坚，散结外，又能化痰（A对）。内消瘰疬丸：【功能】化痰，软坚，散结。当归苦参丸：【功能】活血化瘀（E错），燥湿（B错）清热。拔毒生肌散：【功能】拔毒（C错）生肌。紫草膏：【功能】化腐（D错）生肌，解毒止痛。